药物经皮吸收的主要途径是
A. 透过完整表皮进入真皮和皮下组织，被毛细血管和淋巴管吸收入血
B. 通过汗腺进入真皮和皮下组织，被毛细血管和淋巴管吸收入血
C. 通过皮肤毛囊进入真皮和皮下组织，被毛细血管和淋巴管吸收入血
D. 通过皮脂腺进入真皮和皮下组织，被毛细血管和淋巴管吸收入血
E. 透过完整表皮进入真皮层，并在真皮积蓄发挥治疗作用

正确答案：A。透过完整表皮进入真皮和皮下组织，被毛细血管和淋巴管吸收入血

解析：本题考查药物的经皮吸收。药物的经皮吸收指药物通过角质层和活性表皮进入真皮，被毛细血管吸收进入血液循环发挥作用（A对）。